盐酸氯丙嗪的鉴别反应为
A. 火焰反应，火焰显紫色
B. 供试品的吡啶溶液加铜吡啶试液1滴，即显紫色
C. 供试品溶液加硝酸，即显红色，渐变为黄色
D. 制备衍生物测其熔点，应为174～178℃
E. 供试品溶液与三氯化铁试液作用，即显紫色

正确答案：C。供试品溶液加硝酸，即显红色，渐变为黄色